10岁患儿，8月中旬因发热、嗜睡、头痛3天入院。体温：40℃，意识呈浅昏迷。双侧瞳孔缩小，颈软，膝反射亢进，巴宾斯基征阳性。脑脊液无色透明，细胞数0.1×10⁹/L，中性粒细胞0.8，淋巴细胞0.2，糖2.77mmol/L，氯化物120mmol/L，蛋白300mg/L，外周血象中白细胞数15×10⁹/L，中性粒细胞0.75，淋巴细胞0.25。应诊断为
A. 流行性脑脊髓膜炎
B. 结核性脑膜炎
C. 中毒性菌痢
D. 流行性乙型脑炎
E. 脑型疟疾

正确答案：D。流行性乙型脑炎